轮状病毒引起的急性胃肠炎主要传播途径为
A. 空气传播
B. 接触传播
C. 粪口传播
D. 性传播
E. 血液传播

正确答案：C。粪口传播

解析：轮状病毒引起急性胃肠炎，主要传播途径为粪-口传播。掌握“胃肠道病毒”知识点。